在体内体外均有抗凝血作用的药物是
A. 肝素
B. 华法林
C. 噻氯匹啶
D. 尿激酶
E. 维生素K

正确答案：A。肝素

解析：本题考查肝素。肝素（A对）依赖于激活抗凝血酶，在体内外均有抗凝作用。华法林（B错）属于维生素K拮抗药，仅在体内有抗凝血作用。噻氯匹啶（C错）是抗血小板药物。尿激酶（D错）为溶栓药，临床用于血栓栓塞性疾病的溶栓治疗。维生素K（E错）能促进血液凝固。